下列治疗牙周炎全身应用的药物中最适合于糖尿病患者的是
A. 罗红霉素
B. 四环素
C. 多西环素
D. 米诺环素
E. 甲硝唑

正确答案：C。多西环素

解析：本题考查常用的抗菌药物。治疗牙周炎全身应用的药物中最适合于糖尿病患者的是多西环素（C对）。牙周治疗常用的四环素族药物有四环素（B错）、多西环素、米诺环素（D错），四环素族药物对多种牙周可疑致病菌有抑制作用。其中多西环素因其抗胶原酶活性最强，且不经过肾脏代谢，更适用于糖尿病患者。红霉素、罗红霉素（A错）是大环内酯类抗生素，其作用与螺旋霉素相似，有利于牙周病的治疗，此外两者还对衣原体和支原体有效。青霉素与甲硝唑联合使用治疗侵袭性牙周炎（E错）。